循行于上肢内侧中线的经脉是
A. 手太阳经
B. 手少阳经
C. 手厥阴经
D. 手少阴经
E. 手太阴经

正确答案：C。手厥阴经

解析：该题考查十二经脉的分布规律，属记忆内容。手太阳经分布于上肢外侧后缘（A错）；手少阳经分布于上肢外侧中线（B错）；手厥阴经分布于上肢内侧中线（C对）；手少阴经分布于上肢内侧后缘（D错）；手太阴经分布于上肢内侧前缘（E错）。十二经脉在四肢的分布规律为考察重点，需准确记忆。记忆：阳经，前中后：阳少太。阴经，前中后：太厥少。